下列除哪项外，均是至宝丹的功用
A. 清热
B. 开窍
C. 通便
D. 化浊
E. 解毒

正确答案：C。通便

解析：根据考点还原可作出判断。至宝丹功用没有通便（C对）。记忆：至宝朱砂麝息香，雄黄牛角与牛黄，金银二箔兼龙脑，琥珀还同玳瑁良。